某患者要做腰穿检查，有恐惧感。从医德要求考虑，临床医生应向患者做的主要工作是
A. 要得到患者知情同意
B. 告知做腰穿的必要性，嘱病人配合
C. 告知做腰穿时应注意的事项
D. 因诊断需要，先动员，后检查
E. 动员家属做患者思想工作

正确答案：A。要得到患者知情同意